某小学有大批的学生发生不明原因的腹泻，为了寻找病因及流行的线索，若证实导致这次腹泻的病因，应具有
A. 临床试验
B. 实验室检查
C. 病例调查
D. 队列研究
E. 理论流行病学研究

正确答案：C。病例调查

解析：病例调查是根据病例定义的内容，在一定的时间、范围内搜索类似病例并开展个案调查、入户调查和社区调查。设计调查表，培训调查人员，统一调查内容和方法。对大批发生不明原因的腹泻的学生开展个案调查、入户调查和社区调查（C对），能证实导致这次腹泻的病因，所以应具有病例调查。临床试验用于评价药物或治疗方法的效果（A错）。实验室检查用于检查相关疾病指导临床治疗（B错）。队列研究是判定暴露因素与结局之间有无关联及关联程度大小（D错），无助于。理论流行病学用于客观定量地描述疾病流行状况或预测疾病流行趋势，从理论上探讨疾病的流行规律和防制措施的效果（E错），无助于证实导致这次腹泻的病因。